真菌不能引起的疾病是
A. 外源性感染
B. 内源性感染
C. 潜伏感染
D. 变态反应
E. 毒素中毒

正确答案：C。潜伏感染

解析：潜伏感染是一种病毒的持续性感染状态，在此情况下，不产生病毒。一般来说，大部分转录和翻译过程被阻断。潜伏感染是指病毒来说，而真菌病没有潜伏感染。掌握“真菌概述及主要病原性真菌”知识点。